真人养脏汤主治之久泻久痢的主要病机是
A. 肾阳衰微
B. 脾胃虚寒
C. 肠胃寒积
D. 脾肾虚寒
E. 肝肾虚寒

正确答案：D。脾肾虚寒

解析：该题考查真人养脏汤的主治病证的病机。真人养脏汤功能涩肠固脱，温补脾肾，为治疗脾肾虚寒所致的久泻久痢的常用方（D对ACDE错）。